在T细胞阳性选择过程中，T细胞与周围细胞表面的HLA分子识别结合依靠的是
A. ThTCR
B. TCR
C. 骨髓
D. MALT
E. PP

正确答案：B。TCR

解析：胸腺是T细胞经历阳性选择和阴性选择的场所。在阳性选择的过程中，T细胞通过TCR和周围细胞表面的HLA分子识别结合，结合力低的T细胞发生凋亡而被清除，结合力高的T细胞获得继续分化成熟的机会。掌握“中枢和外周免疫器官”知识点。